为根治幽门螺杆菌感染宜选用
A. 奥美拉唑+阿莫西林+克拉霉素
B. 兰索拉唑
C. 硫糖铝
D. 颠茄
E. 甲氧氯普胺

正确答案：A。奥美拉唑+阿莫西林+克拉霉素

解析：本题考查根除幽门螺杆菌感染的治疗方案。奥美拉唑+阿莫西林+克拉霉素（A对）是联合用药中的根除幽门螺杆菌感染的治疗方案。兰索拉唑（B错）为抑酸剂中的质子泵抑制剂。硫糖铝（C错）为胃黏膜保护药。颠茄（D错）为解痉药。甲氧氯普胺（E错）为促胃肠动力药。